在某地区的死因顺位中，成年人的首位死因是心脏病，并且有连年上升趋势。下列各项描述中不属于该地区优先策略的是
A. 以高胆固醇血症和家族史为指标，确定高危人群，然后做适当干预
B. 通过媒体倡导居民增加身体活动
C. 大力发展心脏专科医院，为病人提供优质的治疗服务
D. 在社区人群中开展减少心脏病危险因素的咨询
E. 加强公共场所与工作场所的控烟

正确答案：C。大力发展心脏专科医院，为病人提供优质的治疗服务

解析：在心脏病预防中医院以及相关的医生要为为病人提供优质的治疗服务（C错，为本题正确答案），并不属于地区预防策略。以高胆固醇血症和家族史为指标，确定高危人群，然后做适当干预（A对）、通过媒体倡导居民增加身体活动（B对）、大力发展心脏专科医院、在社区人群中开展减少心脏病危险因素的咨询（D对）、加强公共场所与工作场所的控烟（E对）是属于地区优先策略中的一部分。